患者，女，30岁，因患癫痫，正在服用抗癫痫药，目前计划怀孕，执业药师对其用药的内容有
A. 应权衡利弊，妊娠期服用抗癫痫药有致畸风险，注意监测和产前筛查
B. 妊娠前和妊娠期建议每日补充5mg叶酸
C. 妊娠期应监测抗癫痫药的血药浓度
D. 妊娠后期3个月建议补充维生素K
E. 抗癫痫药物规律服用半年后，如无发作方可停药

正确答案：A、B、C、D。应权衡利弊，妊娠期服用抗癫痫药有致畸风险，注意监测和产前筛查；妊娠前和妊娠期建议每日补充5mg叶酸；妊娠期应监测抗癫痫药的血药浓度；妊娠后期3个月建议补充维生素K

解析：本题考查妊娠期妇女应用抗癫痫药的注意事项。妊娠及哺乳期妇女应用抗癫痫药有致畸风险，拟妊娠或妊娠期妇女应向专家咨询，并提供产前筛查（A对）（甲胎蛋白检测和孕中期超声波检查）；对接受抗癫痫药治疗的妇女，为降低神经管缺陷的风险，建议在妊娠前和妊娠期应补充叶酸，一日5mg（B对）；抗癫痫药的剂量在妊娠期和分娩后应小心监测（C对），并根据临床情况随时调整；在妊娠后期3个月给予维生素K（D对）；抗癫痫药物不可突然停药（E错），应该逐渐减量。